用紫外-可见分光光度法检查酮体的药物是
A. 肾上腺素
B. 异烟肼
C. 盐酸四环素
D. 地西泮
E. 氟康唑

正确答案：A。肾上腺素

解析：本题考查紫外-可见分光光度法。用紫外-可见分光光度法检查酮体的药物是肾上腺素（A对）。对于在特定波长处具有显著吸收的特定有关物质（特殊杂质），如肾上腺素中的酮体、地蒽酚中二羟基蒽醌的检查，可采用紫外-可见分光光度法检查相关杂质。